肠套叠可见腹痛，并伴有
A. 急性发热
B. 黄疸
C. 呕吐
D. 腹泻
E. 血便

正确答案：E。血便

解析：肠套叠的主要症状为腹痛、果酱样血便（E对）及腊肠样腹部肿块。腹痛伴急性发热可见于腹膜等（A错）。腹痛伴黄疸可见于胆管阻塞性疾病（B错）。腹痛伴呕吐可见于肠梗阻等（C错）。腹痛伴腹泻可见于细菌性痢疾等（D错）。